男孩，1岁半。其基础代谢所需热量占总热量的比例为
A. 30%以下
B. 30%～40%
C. 50%～60%
D. 70%～80%
E. 80%以上

正确答案：C。50%～60%

解析：儿童基础代谢所需热量占总热量的比例为50%（C对）。小儿基础代谢的能量需要量较成人高，随年龄增长逐渐减少。